患者，男，45岁。患慢性胃炎10年余，近1周来干呕时作，口渴心烦，胃脘隐痛，饥而不欲饮食，大便干结，小溲短黄，舌红少苔，脉细偏数，属于
A. 食滞胃脘
B. 胃火炽盛
C. 胃阴亏虚
D. 肝气犯胃
E. 脾胃虚弱

正确答案：C。胃阴亏虚

解析：患者以干呕、胃痛为主诉，故诊断病位在胃；胃阴不足，虚热内生，胃失濡润，气失和降，则胃脘隐隐灼痛，嘈杂不舒；胃中虚热扰动则饥，然胃虚失于和降，故不欲食；胃失和降，胃气上逆，可见干呕；胃阴亏虚，阴津不能上滋，则口渴；不能下润，则大便干结；阴津亏虚，尿液化源不足，故小便短黄；舌红少苔，脉细数，为阴虚内热之征；故诊断为胃阴亏虚证（C对）。食滞胃脘证，临床表现为胃脘胀满疼痛、拒按，厌恶食物，嗳腐吞酸，或呕吐酸馊食物，吐后胀痛得减，或腹胀腹痛，泻下不爽，肠鸣，矢气臭如败卵，大便酸腐臭秽，舌苔厚腻，脉滑（A错）。胃火炽盛证，临床表现为胃脘灼痛、拒按，消谷善饥，口气臭秽，齿龈红肿疼痛，甚则化脓、溃烂，或见齿衄，渴喜冷饮，大便秘结，小便短黄，舌红苔黄，脉滑数（B错）。肝气犯胃证，临床表现为胃脘胁肋胀痛或窜痛，胃脘痞满，呃逆，嗳气，吞酸嘈杂，饮食减少，情绪抑郁，善太息，或烦躁易怒，舌淡红，苔薄白或薄黄，脉弦（D错）。脾胃虚弱证，临床表现为食入即吐，口淡无味，时时呕吐清涎，脘痞腹胀，倦怠嗜卧，舌淡，苔白润，脉缓滑无力（E错）。